男婴，12天。拒奶、少动、体温不升10小时急诊入院。查体：重病容，面色苍白，前囟平，颈软，心音低钝，双肺未闻及啰音，腹胀，肝右肋下3.5cm。脐有少许分泌物。实验室检查：血WBC5.0×10⁹/L，N0.70，L0.30。最可能的诊断是
A. 新生儿寒冷损伤综合征
B. 新生儿化脓性脑膜炎
C. 新生儿肺炎
D. 新生儿颅内出血
E. 新生儿败血症

正确答案：E。新生儿败血症

解析：本例患儿拒奶、少动、体温不升，重病容，面色苍白，心音低钝，双肺未闻及啰音，腹胀，肝右肋下3.5cm，脐有少许分泌物，最可能的诊断是新生儿败血症（E对）。新生儿寒冷损伤综合征（A错）主要表现为低体温和皮肤硬肿。新生儿化脓性脑膜炎（B错）前囟饱满，脑膜刺激征阳性。双肺未闻及啰音，排除新生儿肺炎（C错）。新生儿颅内出血（D错）常见颈项强直，而本例颈软，排除新生儿颅内出血。